杜仲具有的功效是
A. 补肝肾，强筋骨，安胎
B. 补阳益阴，固精安胎
C. 补肾壮阳，温脾止泻
D. 补肝肾，行血脉，强筋骨
E. 祛风湿，强筋骨，明目

正确答案：A。补肝肾，强筋骨，安胎

解析：该题考查杜仲的功效，属记忆内容。杜仲味甘，性温；入肝、肾经；具有补肝肾，强筋骨，安胎的功效（A对BCDE错）。